65岁以上人口数与15～64岁人口数的百分比称为
A. 老年人口负担系数
B. 总负担系数
C. 老年人口系数
D. 老龄化指数
E. 以上均不是

正确答案：A。老年人口负担系数

解析：本题考查老年人口负担系数。65岁以上人口数与15～64岁人口数的百分比称为老年人口负担系数（A对BCDE错）。